蔬菜水果中含量丰富的成分是
A. 蛋白质、脂肪、碳水化合物和有机酸
B. 蛋白质、矿物质、膳食纤维和有机酸
C. 蛋白质、维生素、矿物质和有机酸
D. 维生素、矿物质、膳食纤维和有机酸
E. 脂肪、碳水化合物、膳食纤维和有机酸

正确答案：D。维生素、矿物质、膳食纤维和有机酸

解析：本题考查蔬菜水果中含量丰富的成分。蔬菜水果中含量丰富的成分是维生素、矿物质、膳食纤维和有机酸（D对ABCE错）。